肾致密斑的作用是直接感受
A. 肾血管血压变化
B. 肾血流Na⁺变化
C. 肾小管内压变化
D. 肾小管液Na⁺含量变化
E. 入球小动脉牵张刺激

正确答案：D。肾小管液Na⁺含量变化